左、右肺根内各结构在肺门处的位置关系，自前向后依次为
A. 肺静脉、肺动脉和主支气管
B. 肺动脉、肺静脉和主支气管
C. 肺动脉、主支气管和肺静脉
D. 肺静脉、主支气管和肺动脉
E. 主支气管、肺静脉和肺动脉

正确答案：A。肺静脉、肺动脉和主支气管

解析：两肺根内的结构排列自前向后依次为：肺静脉、肺动脉和主支气管（A对）。